详细向患者讲清配合治疗的必要性，以获得患者与医师的合作是
A. 患者的权利
B. 患者的义务
C. 医生的权利
D. 医生的义务
E. 患者和医生共同的义务

正确答案：D。医生的义务